不得从事高致病性病原微生物实验活动的是
A. 一级、二级实验室
B. 三级实验室
C. 四级实验室
D. 三级、四级实验室
E. 一级、二级、三级实验室

正确答案：A。一级、二级实验室